在下列文献中，最早提出医疗保密的是
A. 《纽伦堡法典》
B. 《赫尔辛基宣言》
C. 《希波克拉底誓言》
D. 《夏威夷宣言》
E. 《千金要方》

正确答案：C。《希波克拉底誓言》